女，36岁，已诊断肾病综合征，近两日右下肢疼凉，右足背动脉搏动触不清，趾指皮肤发绀，应首先考虑的合并症是
A. 下尿路感染
B. 右下肢静脉血栓
C. 心源性休克
D. 急性肾衰
E. 右下肢动脉栓塞

正确答案：E。右下肢动脉栓塞

解析：中青年女性，肾病综合征患者，近两日右下肢疼凉，右足背动脉搏动触不清（提示动脉栓塞可能），趾指皮肤发绀，应首先考虑的合并症是右下肢动脉栓塞（E对）。右下肢静脉血栓（B错）、下尿路感染（A错）及急性肾衰（D错）均肾病综合症常见的并发症，但临床表现与题干不符合。右下肢静脉血栓主要表现为右下肢水肿、发热，不会有足背动脉搏动触不清。下尿路感染主要表现为膀胱刺激症状即尿频、尿急、尿痛及排尿困难。一般无畏寒、发热及腰酸、痛表现。急性肾衰常会出现少尿及全身其他系统受累症状如恶心、呕吐、呼吸困难等。心源性休克（C错）不是肾病综合征的常见并发症且临床表现不符合。